流行性腮腺炎属于
A. 甲类传染病
B. 乙类传染病
C. 丙类传染病
D. 丁类传染病
E. 戊类传染病

正确答案：C。丙类传染病

解析：丙类传染病是指流行性感冒、流行性腮腺炎、风疹、急性出血性结膜炎、麻风病、流行性和地方性斑疹伤寒、黑热病、包虫病、丝虫病，除霍乱、细菌性和阿米巴性痢疾、伤寒和副伤寒以外的感染性腹泻病。掌握“传染病的概述”知识点。